能够抑制胸苷酸合酶、二氢叶酸还原酶等多靶点的是
A. 氟达拉滨
B. 卡莫司汀
C. 顺铂
D. 环磷酰胺
E. 培美曲塞

正确答案：E。培美曲塞

解析：本题考查嘌呤拮抗剂类抗肿瘤药。培美曲塞（E对）具有多靶点，能够抑制胸苷酸合成酶、二氢叶酸还原酶和甘氨酰胺核苷酸甲酰转移酶、氨基咪唑甲酰胺核苷酸甲酰基转移酶等的活性。氟达拉滨（A错）为阿糖腺苷的氟化核苷酸衍生物，药理作用与阿糖胞苷相似。卡莫司汀（B错）为亚硝脲类化疗药物,又称卡氮芥,广谱抗癌药物。顺铂（C错）是金属铂类络合物,属于细胞周期非特异性抗肿瘤药,可破坏DNA,抑制肿瘤生长。环磷酰胺（D错）为在体内转变为烷化作用很强的烷化剂，与DNA结合而抑制DNA的合成。